男性，56岁，阵发性腹痛6天，伴恶心腹胀2天入院，无发热，体格检查：腹膨隆，见肠型，肠鸣音亢进，有气过水声，腹部平片见腹中部扩张小肠呈“阶梯状”液平，结肠内少量积气，可能的诊断是
A. 麻痹性肠梗阻
B. 低位小肠梗阻
C. 高位小肠梗阻
D. 坏死性小肠炎
E. 乙状结肠扭转

正确答案：B。低位小肠梗阻

解析：中年男性患者，阵发性腹痛，伴恶心、腹胀，无发热，查体腹膨隆，见肠型，肠鸣音亢进，有气过水声（提示肠梗阻），腹部平片见腹中部扩张，小肠呈“阶梯状”液平（提示低位小肠梗阻），结合患者病史、体查和腹部平片，最可能的诊断为低位小肠梗阻（B对）。麻痹性肠梗阻（A错）多表现为腹部持续性胀痛或不适，查体肠鸣音减弱或消失，腹部平片表现为大、小肠全部充气扩张。高位小肠梗阻（C错）以呕吐为突出表现，呕吐出现早且频繁，腹胀不明显。坏死性小肠炎即急性出血性肠炎（P357）（D错）多见于儿童和青少年，发病前多有不洁饮食史或上呼吸道感染史，临床以急性腹痛、腹胀、呕吐、腹泻、便血及发热、寒战等全身中毒症状为主要表现，腹部平片无小肠胀气等表现。乙状结肠扭转（E错）好发于老年男性，常表现为腹部持续性胀痛，左腹膨胀明显，腹部平片可见马蹄状巨大的双腔充气袢。